牛黄上清丸主治热毒内盛、风火上攻所致的头痛眩晕，咽喉肿痛、牙龈肿痛，其功能是
A. 清热泻火，利尿通便
B. 清肺利肺，降逆除烦
C. 清热泻火，散风止痛
D. 清胃泻火，解毒消肿
E. 清热解毒，散瘀止痛

正确答案：C。清热泻火，散风止痛

解析：本题考查的是牛黄上清丸的功能。牛黄上清丸主治热毒内盛、风火上攻所致的头痛眩晕，咽喉肿痛、牙龈肿痛，其功能是清热泻火，散风止痛（C对）。牛黄上清丸：【功能】清热泻火，散风止痛。黛蛤散：【功能】清肝利肺，降逆除烦（B错）。清胃黄连丸：【功能】清胃泻火，解毒消肿（D错）。抗癌平丸：【功能】清热解毒，散瘀止痛（E错）。功能为清热泻火，利尿通淋（A错）的中成药，2022年考试指南未明确说明。